感染性腹泻的年龄分布以学龄前儿童与下列哪个年龄组的人为发病高峰
A. 10～20岁青少年
B. 20～40岁青壮年
C. 40～60岁中年
D. 60～80岁老年
E. ＞80岁

正确答案：B。20～40岁青壮年